男性，78岁。左下颌后牙黏膜出现破溃疼痛1年。口腔检查：左下67残冠，颊侧黏膜上有一个直径1.5cm的深溃疡，周围硬，边缘不齐，底部呈菜花状，扪诊基底部有硬结。触诊下颌下淋巴结肿大。为明确诊断，最佳辅助诊断方法是
A. X线片检查
B. 刮片检查
C. 结核菌素试验
D. 活体组织病理学检查
E. 超声体层检查

正确答案：D。活体组织病理学检查

解析：本题考查口腔颌面部肿瘤的诊断。根据题干，颊侧黏膜上有一深溃疡，周围硬，边缘不齐，底部呈菜花状，扪诊基底部有硬结，触诊下颌下淋巴结肿大，可推测为颊癌，为明确诊断，最佳辅助诊断方法是活体组织病理学检查（D对），此种检查方法是金标准。X线片检查（A错）主要用于了解骨组织肿瘤的性质及侵犯范围，用此法并不能准确判断肿物的类别，对疾病的确诊意义不大。刮片检查（B错）主要用于研究子宫颈部细胞有无异常。结核菌素试验（C错）用于结核杆菌的检查，而此病是为了确诊肿物类别的，因此不采用。超声体层检查（E错）对口腔颌面部囊性肿瘤和软组织肿瘤，如原发于腮腺、下颌下腺颈部的肿瘤的诊断有帮助，但仅能判断出肿物的位置、界限、大小，不能准确地确定肿物的性质。